由器质性病变导致开口度逐渐变小，以致完全不能开口，称为
A. 关节盘移位
B. 咀嚼肌群痉挛
C. 颞下颌关节强直
D. 癔病性牙关紧闭
E. 破伤风后牙关紧闭

正确答案：C。颞下颌关节强直

解析：颞下颌关节强直是指由于疾病、损伤或外科手术而导致的关节固定、运动丧失。在临床上可分为两类：关节内强直是指关节内发生病变，造成关节内纤维性或骨性粘连；关节外强直是指关节外上下颌间皮肤、黏膜或深层组织发生病变，也被称为假性关节强直。掌握“颞下颌关节强直”知识点。